与脉络丛的形成有关的是
A. 下矢状窦
B. 蛛网膜粒
C. 下髓帆
D. 软脑膜
E. 蛛网膜

正确答案：D。软脑膜

解析：在脑室的一定部位，软脑膜及其血管与该部的室管膜上皮共同构成脉络组织。在某些部位，脉络组织的血管反复分支成丛，连同其表面的软脑膜（D对）和室管膜上皮一起突入脑室，形成脉络丛，脉络丛是产生脑脊液的主要结构。脉络丛形成与软脑膜有关而不是与蛛网膜（E错）有关。下矢状窦（A错）为硬脑膜窦，是脑内静脉血液回流的通道。蛛网膜粒（B错）为脑蛛网膜在上矢状窦形成的突起结构，与脑脊液回流有关。下髓帆（C错）为第四脑室壁的组成结构，与脉络丛形成无关。